吗啡治疗胆绞痛需要合用的药物是
A. 阿托品
B. 哌替啶
C. 阿司匹林
D. 对乙酰氨基酚
E. 可待因

正确答案：A。阿托品

解析：吗啡能兴奋胃肠平滑肌和括约肌，提高张力，甚至痉挛，使胃肠平滑肌推进性蠕动减弱，治疗胆绞痛和肾绞痛时需加用解痉药，如阿托品（A对）。